氨基苷类抗生素的主要不良反应是
A. 胃肠道反应
B. 肝脏损害
C. 肌痉挛
D. 第八对脑神经损害
E. 灰婴综合征

正确答案：D。第八对脑神经损害

解析：本题考查氨基苷类抗生素的不良反应。氨基苷类抗生素的主要不良反应是第八对脑神经损害（D对）。长期使用化疗药物或抗生素可引起胃肠道反应（A错）。肝脏为主要的排毒器官，药物在肝脏代谢，药物本身或其代谢产物会对肝脏会造成损害，例如许多的化疗药物都有肝脏毒性（B错）。肌痉挛是肌肉突发性猛烈收缩。疲劳、电解质平衡紊乱和寒冷刺激均可引起肌痉挛（C错）。灰婴综合征（E错）是指在妊娠期，尤其是妊娠末期和临产的24小时内孕母使用氯霉素，致使出生的新生儿出现呕吐、呼吸急促或不规则、皮肤发灰、低体温、软弱无力等症状，甚至造成死亡。